休克淤血性缺氧期时应用扩血管药物改善微循环主要是指：
A. 扩张小动脉
B. 扩张微动脉
C. 扩张后微动脉
D. 扩张毛细血管前括约肌
E. 扩张毛细血管后微血管

正确答案：E。扩张毛细血管后微血管

解析：休克淤血性缺氧期时微动脉、后微动脉和毛细血管前括约肌收缩性减弱甚至扩张，大量血液涌入真毛细血管网。微静脉虽也表现为扩张，但因血流缓慢，细胞嵌塞，使微循环流出道阻力增加，毛细血管后阻力大于前阻力而导致血液淤滞于微循环中，所以应用扩血管药物改善微循环主要是指扩张毛细血管后微血管（E对ABCD错）。